乳癌多发生于
A. 乳头乳晕区
B. 内上象限
C. 外上象限
D. 内下象限
E. 外下象限

正确答案：C。外上象限

解析：乳腺癌的多发于乳腺外上象限（C对），占50%以上，扪诊时应重点检查。